欲配制1000mL冰点下降值0.05℃的注射液，需要加入氯化钠多少克为等渗溶液
A. 8
B. 8.5
C. 9
D. 9.5
E. 10

正确答案：A。8

解析：本题考查的是冰点降低数据法。欲配制1000mL冰点下降值0.05℃的注射液，需要加入氯化钠8克（A对）为等渗溶液。冰点降低数据法：血浆冰点为-0.52℃，根据物理化学原理，任何溶液其冰点降低到-0.52℃，即与血浆等渗。一些药物1%水溶液的冰点降低数据可查表得到。根据公式可以计算所需要加入渗透压调节剂的量。计算公式如下：W=（0.52-a）/b。式中，W——配制100ml等渗溶液需加入的等渗调节剂的量（g/ml）；a——未经调整的药物溶液引起的冰点下降度；b——1%（g/ml）等渗调节剂溶液所引起的冰点下降度。本题可根据公式W=（0.52-a）/b计算，其中a=0.05；b为1%（g/ml）氯化钠溶液所引起的冰点下降度，即b=0.58℃，由此可计算出配置100ml所需氯化钠的量。W=（0.52-a）/b=（0.52-0.05）/0.58=0.81≈0.8g/ml。故配置1000ml所需氯化钠的量为1000ml×0.8g/ml/100=8g，所以本题的正确答案为8g。